我国法定传染病中甲类传染病包括
A. 天花和鼠疫
B. 狂犬病和天花
C. 霍乱和副霍乱
D. 鼠疫和霍乱
E. 艾滋病和霍乱

正确答案：D。鼠疫和霍乱

解析：甲类传染病有两个：①鼠疫；②霍乱（D对），城镇2小时内上报，农村6小时内上报。狂犬病（B错）和艾滋病（E错）属于乙类传染病，城镇6小时内上报，农村12小时内上报。天花（AB错）已被消灭。